男性，54岁。1年来因右侧后牙痛多处求治无效。每次发作电击样痛，持续不到1分钟。查右上下后牙多个龋坏牙和残根，为鉴别三叉神经痛的诊断首先应问患者的是
A. 服药史
B. “扳机点”
C. 咀嚼痛
D. 治疗史
E. 全身病史

正确答案：B。“扳机点”

解析：因为“扳机点”是三叉神经痛临床表现中最具诊断意义的特殊症状，为鉴别三叉神经痛的诊断首先应问患者的是是否有“扳机点”。掌握“可复性、急慢性牙髓炎”知识点。